炉甘石洗剂制备时，处方中的羧甲基纤维素钠是作为
A. 潜溶剂
B. 助溶剂
C. 增溶剂
D. 助悬剂
E. 保湿剂

正确答案：D。助悬剂

解析：本题考查混悬剂的附加剂。炉甘石洗剂制备时，处方中的羧甲基纤维素钠是作为助悬剂（D对）。为了增加混悬剂的物理稳定性，在制备时需加入能使混悬剂稳定的附加剂，包括润湿剂、助悬剂、絮凝剂和反絮凝剂等。混悬剂常用的助悬剂：①低分子助悬剂，如甘油、糖浆剂等。②高分子助悬剂，主要分为天然和合成高分子助悬剂。常用的天然高分子助悬剂及其用量分别为阿拉伯胶5%～15%、西黄蓍胶0.5%～1%、琼脂0.3%～0.5%，此外尚有海藻酸钠、白及胶、果胶等。常用的合成高分子助悬剂有甲基纤维素、羧甲纤维素钠、羟乙纤维素、聚维酮、聚乙烯醇等，一般用量为0.1%～1.0%，此类助悬剂性质稳定，受pH影响小，但与某些药物有配伍变化。③硅酸类，如胶体二氧化硅、硅酸铝、硅皂土等。液体制剂的潜溶剂（A错）：系指能形成氢键以增加难溶性药物溶解度的混合溶剂。能与水形成潜溶剂的有乙醇、丙二醇、甘油、聚乙二醇等。液体制剂的助溶剂（B错）：难溶性药物与加人的第三种物质在溶剂中形成可溶性分子间络合物、缔合物或复盐等，以增加药物在溶剂中的溶解度。这第三种物质称为助溶剂。液体制剂的增溶剂（C错）：增溶是指难溶性药物在表面活性剂形成的胶团作用下，在溶剂中溶解度增加并形成溶液的过程。具有增溶作用的表面活性剂称为增溶剂。软膏剂、乳膏剂根据需要可加人保湿剂（E错）、抑菌剂、增稠剂、稀释剂、抗氧剂及透皮促进剂。